作用于中枢神经系统，反复使用可能产生依赖性的药物是
A. 氯丙嗪
B. 丙咪嗪
C. 苯妥英钠
D. 吡拉西坦
E. 可待因

正确答案：E。可待因

解析：本题考查可待因。可待因（E对）在体内约有10%的药物代谢生成吗啡，长期和大量服用可待因会产生成瘾性。